经初步处理后，患者已清醒，下一步最宜采取的治疗是
A. 生物反馈治疗
B. 物理治疗
C. 药物治疗
D. 针灸治疗
E. 心理治疗

正确答案：E。心理治疗

解析：患者已诊断为假性癫痫发作，且经暗示治疗等初步处理后，患者已清醒，但患者内心对于发病前与邻居的口角等经历仍然存在心理障碍，应积极进行心理治疗（E对），疏通患者内心的积郁，使患者释怀，这样才能防止症状复发。生物反馈治疗（A错）、物理治疗（B错）、药物治疗（C错）、针灸治疗（D错）均不能根除患者复发的可能。